现代医学目的原则体现在
A. 高尚、节制和谨慎原则
B. 公正和公平原则
C. 供得起和经济上可持续原则
D. 尊重人的选择和尊严的原则
E. 以上全包括

正确答案：E。以上全包括

解析：本题考查现代医学目的原则。现代医学目的原则体现在：高尚、节制和谨慎原则；公正和公平原则；供得起和经济上可持续原则；尊重人的选择和尊严的原则（E对ABCD错）。